有关P/O比值的叙述正确的是
A. 是指每消耗1mol氧分子所消耗的无机磷的摩尔数
B. 是指每消耗1mol氧分子所消耗的ATP的摩尔数
C. 是指每消耗1mol氧原子所消耗的无机磷的摩尔数
D. P/O比值不能反映物质氧化时生成ATP的数目
E. P/O比值反映物质氧化时所产生的NAD⁺数目

正确答案：C。是指每消耗1mol氧原子所消耗的无机磷的摩尔数